在肺痨的病程发展演变中，尤易受损的脏腑是
A. 肺、脾、肾
B. 肺、心、肾
C. 肺、心、肝
D. 肺、心、脾
E. 肺、肝、肾

正确答案：A。肺、脾、肾

解析：肺痨的病位主要在肺，与脾、肾两脏关系最为密切（A对），同时也可涉及心、肝，基本病机以痨虫损肺，肺阴亏虚为主，并可导致气阴两虚，甚则阴损及阳。病初肺体受损，肺阴被耗，肺失滋润表现肺阴亏损之候，继则肺肾同病，兼及心肝，而致阴虚火旺；或因肺脾同病，导致气阴两伤。病久肺、脾、肾三脏皆损，阴损及阳，出现阴阳两虚。内外因素可以互为因果，但感染痨虫是发病关键，正气亏虚是肺痨发生发展的重要基础。